医务人员应共同遵守的道德原则以及建立良好医际关系的思想基础是
A. 病人利益至上
B. 医生利益至上
C. 医院关系至上
D. 社会利益至上
E. 以上都不是

正确答案：A。病人利益至上

解析：维护病人利益即“病人利益至上（A对）”，是医务人员的共同义务和天职，是医务人员所应共同遵守的道德原则，也是建立医务人员之间良好关系的思想基础。这个原则要求医务人员理解和同情病人，关心和满足病人的生理、心理需要，以和蔼的态度、诚挚的语言和高度负责的精神进行诊治和护理，使病人有一种温暖感、信任感和安全感；对同事中出现的任何损害病人利益或人格的言行，都要敢于抵制和批评。